下列被称为“清净之府”的是
A. 脑
B. 髓
C. 骨
D. 脉
E. 胆

正确答案：E。胆

解析：胆汁是精纯、清净的精微物质，故胆被称为“中精之府”、“清净之府”（E对）、“中清之府”。脑有“髓海”、“精明之府”、“元神之府”之称（A错）。髓有“骨之充”之称（B错）。骨有“髓之府”之称（C错）。冲脉有“十二经脉之海”、“五脏六腑之海”、“血海”之称（D错）。